对二尖瓣狭窄程度的判定最有价值的检查是
A. 听诊
B. 胸部X线摄影
C. 心电图检查
D. 胸部CT扫描
E. 二维超声心动图检查

正确答案：E。二维超声心动图检查